男，32岁。周期性空腹及夜间上腹痛4年，饱食后突发剧烈上腹痛3小时。查体：上腹部腹肌紧张，压痛阳性。肝浊音界消失。为明确诊断应选择的检查是
A. 立位腹部X线平片
B. 血沉
C. CT检查
D. 超声检查
E. 大便隐血试验

正确答案：A。立位腹部X线平片

解析：该患者疑诊为十二指肠溃疡穿孔。为明确诊断，首选立位腹部X线平片检查（A对），若显示膈下新月形游离气体影，即可确定诊断。腹部CT（C错）价格昂贵，且对空腔脏器疾病检查效果不佳。超声检查（D错）受气体干扰，不用于空腔脏器疾病的诊断。大便隐血试验（E错）阳性只能提示消化道出血，而不能明确出血位置。血沉（B错）即红细胞沉降率，用于结核病、风湿热等的辅助检查，不用于十二指肠溃疡穿孔的诊断。